属于B型药品不良反应的情况是
A. 青霉素导致过敏性休克
B. 阿托品导致口干
C. 孕妇服用己烯雌酚，有可能导致其女儿青春期后患阴道癌
D. 氯苯那敏导致嗜睡
E. 硝酸甘油导致心律加快

正确答案：A。青霉素导致过敏性休克

解析：本题考查B型药品不良反应。B型药品不良反应又称剂量不相关的不良反应，与药物固有的正常药理作用无关，而与药物变异和人体特异体质有关，包括药物过敏反应和特异质反应（A对）。